对厌氧菌有强大杀菌作用，但对肠球菌无效的药物是
A. 氨曲南
B. 头孢吡肟
C. 头孢曲松
D. 克林霉素
E. 利奈唑胺

正确答案：E。利奈唑胺